决定基托伸展范围不必考虑
A. 缺牙多少和部位
B. 基牙健康状况
C. 牙槽嵴吸收程度
D. （牙合）力大小
E. 患者的要求

正确答案：E。患者的要求

解析：基托的伸展范围：根据缺牙的部位，基牙的健康状况，牙槽嵴吸收的程度，（牙合）力的大小等情况而定。对于非游离缺失的牙支持式义齿，在保证义齿固位和稳定的前提下，尽量缩小基托范围，使患者感觉舒适、美观。如个别前牙缺失，牙槽嵴丰满者可不放唇侧基托。对于游离缺失的混合支持式或黏膜支持式义齿，在不影响唇颊舌周围组织功能活动的前提下，应尽量扩大基托伸展范围，以获得足够的固位、稳定和支持。掌握“局部义齿人工牙及基托”知识点。